男性，18岁，BMI=24。其体重属于
A. 正常
B. 偏轻
C. 超重
D. 肥胖
E. 无法判断

正确答案：C。超重